开始形成新骨，不成熟的纤维状骨逐渐充填拔牙窝
A. 3～6个月
B. 3～4天
C. 5～8天
D. 24～35天
E. 38天以后

正确答案：C。5～8天

解析：术后5～8天开始形成新骨，不成熟的纤维状骨逐渐充填拔牙窝。在牙槽突的尖锐边缘骨吸收继续进行，当拔牙窝充满骨质时，牙槽突的高度将降低。掌握“牙拔除术前准备、器械、心血管及拔牙愈合过程”知识点。